属于纯黏液腺的小涎腺的是
A. 唇腺
B. 舌下腺
C. 腭腺
D. 下颌下腺
E. 腮腺

正确答案：C。腭腺

解析：本题考查唾液腺组织学特点。舌腭腺、腭腺（C对）均属纯黏液腺。纯浆液性腺：腮腺（E错）、味腺；纯黏液性腺：舌腭腺、舌后腺、腭腺；混合偏浆液性：下颌下腺（D错）；其余都是混合偏黏液性腺（AB错）。